患者心悸而痛，胸闷气短，动则更甚，自汗，神倦怯寒，四肢欠温，舌质淡胖，边有齿痕，苔白腻，脉沉细迟。其证候是
A. 痰浊闭阻
B. 寒凝心脉
C. 气阴两虚
D. 心肾阳虚
E. 水饮凌心

正确答案：D。心肾阳虚

解析：题中患者以心悸而痛，胸闷气短为主症，故诊断为胸痹，心悸而痛，胸闷气短为心神阳虚，胸阳不振，气机不畅，血行瘀滞，心脉失养所致，动则耗气，气愈虚则阳愈虚，故动则更甚，阳虚不能固表，故自汗，阳虚气血不能达于四末，故神倦怯寒，四肢欠温，舌质淡胖，边有齿痕，苔白腻，脉沉细迟为为心肾阳虚，水湿内生之象，故辨为心肾阳虚证（D对）。胸痹痰浊闭阻证以胸闷痛而心痛微，痰多气短，肢体沉重为主症，脉多滑（A错）。胸痹寒凝心脉证以卒然心痛如绞，心痛彻背，喘不得卧为主症（B错）。胸痹气阴两虚证以心胸隐痛，时作时休，心悸气短为主症（C错）。胸痹水饮凌心证是心肾阳虚日久，阳虚不能制水，水凌心肺所致，伴有动则气喘及面浮肢肿等水肿症状（E错）。